属尿嘧啶抗代谢物的药物是
A. 甲氨蝶呤
B. 巯嘌呤
C. 吉西他滨
D. 长春瑞滨
E. 卡莫氟

正确答案：E。卡莫氟